抗原提呈功能最强的细胞是
A. NK细胞
B. 树突细胞
C. T细胞
D. B细胞
E. 巨噬细胞

正确答案：B。树突细胞

解析：本题考查免疫细胞。抗原提呈功能最强的细胞是树突细胞（B对）。抗原提呈细胞（APC）是能够加工抗原并以抗原肽-MHC分子复合物的形式将抗原肽提呈给T细胞的一类细胞，在机体的免疫识别、免疫应答与免疫调节中起重要作用。树突状细胞（DC）是体内功能最强的专职性APC，可激活初始T细胞。B细胞（D错）是同时具有产生抗体和抗原提呈功能的免疫细胞，但他和NK细胞（A错）、T细胞（C错）及巨噬细胞（E错）均不是抗原提呈功能最强的细胞。